社区牙周指数不包括下面哪一项检查
A. 牙龈出血
B. 牙结石
C. 牙槽骨吸收
D. 浅牙周袋
E. 深牙周袋

正确答案：C。牙槽骨吸收

解析：CPI检查内容：检查牙龈出血情况、探测龈下牙石、探测龈沟或牙周袋深度。掌握“牙周病流行病学及分级预防”知识点。